娱乐场所观众厅进行地面消毒和空气消毒的时间是
A. 当呼吸道传染病流行期间
B. 每天一次
C. 每周一次
D. 每月一次
E. 不定期

正确答案：A。当呼吸道传染病流行期间

解析：本题考查娱乐场所观众厅进行地面消毒和空气消毒的时间。在呼吸道传染病流行期间（A对BCDE错），应对娱乐场所观众厅进行地面消毒和空气消毒。